WHO预防控制肺炎和腹泻的全球行动计划的主要干预手段之一
A. 到2025年腹泻导致的死亡率降到1‰以下
B. 前六个月纯母乳喂养婴儿
C. “三管一灭”
D. 设立腹泻病门诊
E. 轮状病毒疫苗接种

正确答案：B。前六个月纯母乳喂养婴儿

解析：本题考查WHO预防控制肺炎和腹泻的全球行动计划的主要干预手段。WHO预防控制肺炎和腹泻的全球行动计划的主要干预手段包括：前六个月纯母乳喂养婴儿（B对ACDE错），疫苗接种，用肥皂洗手，喝安全的饮用水，使用经过改良的卫生设施，适当的治疗等。